衰老红细胞难以通过微小血管和孔隙的主要原因是
A. 渗透脆性增加
B. 细胞体积增大
C. 悬浮稳定性下降
D. 血红蛋白减少
E. 变形能力减退

正确答案：E。变形能力减退

解析：衰老红细胞难以通过微小血管和孔隙的主要原因在于其变形能力减退（E对）（P64）。渗透脆性增加（A错）（P62）是指红细胞在低渗盐溶液中更容易发生膨胀破裂的性质。细胞体积增大和血红蛋白减少（BD错）（P61）会影响红细胞的变形能力，导致变形能力改变影响红细胞穿梭，但它们不是影响衰老红细胞难以通过微小血管和孔隙的主要原因。悬浮稳定性下降（C错）（P61）与红细胞沉降率有关。